下列除哪一项外都是形成阳偏胜的主要原因
A. 感受温热之邪
B. 因气滞、血瘀、食积等郁而化热
C. 阴液不足，阳气浮动
D. 感受阴邪，从阳化热
E. 情志内伤，五志过极而化火

正确答案：C。阴液不足，阳气浮动

解析：阴液不足，阳气浮动是阴虚阳相对偏胜（C错，为本题正确答案）。形成阳偏盛的原因，多由于感受温热阳邪（A对），或虽感受阴邪而从阳化热（D对），也可由于情志内伤，五志过极化火（E对），或因气滞、血淤、食积等郁而化热所致（B对），总之，邪从外来则多因感受阳邪，邪自内生，则多与气机郁结化火有关。